脉管系
A. 由心和血管系组成
B. 淋巴液汇人静脉
C. 动脉内含动脉血
D. 静脉内含静脉血
E. 只有运送物质的功能

正确答案：B。淋巴液汇人静脉

解析：脉管系统包括心血管系统和淋巴系统（A错）。淋巴液沿淋巴管道向心流动，最后汇入静脉（B对）。脉管系统不只是有运送物质的功能（E错），对维持人体内环境理化特性的相对稳定以及实现防卫功能等均具有重要作用。